下列乙肝病毒标记物中反映HBV有活动性复制和传染性的是
A. 表面抗原（HBsAg）
B. 表面抗体（抗-HBs）
C. e抗原（HBeAg）
D. e抗体（抗-HBe）
E. 核心抗体（抗-HBc）

正确答案：C。e抗原（HBeAg）

解析：乙肝是有乙型肝炎病毒（HBV）导致的病毒性肝炎，HBV的抗原组成包括HBeAg、HBsAg和HBcAg。HBeAg（e抗原）（C对）游离存在于血液循环中，也可存在于肝细胞的胞质和包膜上，其消长与病毒颗粒及病毒DNA多聚酶的消长基本一致，故可作为HBV由活动性复制及具有强传染性的指标之一；HBeAg可刺激机体产生抗-HBe（e抗体）（D错），对清除HBV有一定的作用，抗HBe阳转表示病毒复制多处于静止状态，传染性降低。HBsAg（表面抗原）（A错）为糖基化蛋白，大量存在与感染者的血液中，是HBV感染的主要标志，HBsAg本身只有抗原性，是制备疫苗的最主要成分，但无传染性；HBsAg可刺激机体产生抗-HBs（表面抗体），抗-HBs（B错）阳性表示对HBV有免疫力，见于乙型肝炎恢复期、既往感染及乙肝疫苗接种后。HBcAg（核心抗原）为HBV的衣壳蛋白，主要存在于HBV核衣壳表面，其外被包膜所覆盖，一般不游离于血液循环中，故较少用于临床常规检测；HBcAg抗原性强，能刺激机体产生非保护性抗体（核心抗体）抗-HBc（E错），HBV感染者几乎均可检出，抗HBcIgM阳性提示急性期或慢性肝炎急性发作，抗HBcIgG出现较迟，但可保持多年甚至终身。